颈动脉窦灌注压升高时诱发降压反射的是
A. 心交感神经冲动增多
B. 交感缩血管纤维冲动增多
C. 心迷走神经冲动增多
D. 窦神经冲动增多
E. 交感舒血管纤维冲动增多

正确答案：D。窦神经冲动增多